男，20岁，因躁狂发作入院，表现为动作增多，语速加快，滔滔不绝，言语夸大，好管闲事。入院后给予口服碳酸锂1.0g/d，2天后出现恶心、呕吐和轻微手抖，无意识障碍。应立即采取的措施是
A. 血液透析
B. 停药，检查血锂浓度
C. 行胃镜检查
D. 加用卡马西平
E. 洗胃

正确答案：B。停药，检查血锂浓度

解析：青年男性患者，临床表现为情感高涨、思维奔逸、活动增多，为典型躁狂发作，其药物治疗以心境稳定剂为主，主要为碳酸锂。口服碳酸锂时若出现恶心、呕吐和轻微手抖，为锂盐的不良反应，应立即停药，并检查血锂浓度，及时抢救，必要时可洗胃（E错），行血液透析（A错）；若不耐受该药，后续可改服卡马西平（D错）或丙戊酸盐等抗癫痫药做替代治疗。